以下疾病除哪个外均为自然疫源性疾病
A. 钩体病
B. 流行性出血热
C. 森林脑炎
D. 地方性甲状腺肿
E. 狂犬病

正确答案：D。地方性甲状腺肿

解析：本题考查自然疫源性疾病的概念。自然疫源性是指某些疾病的病原体在繁衍种属过程中不依赖于人，而在野生动物或家畜中传播，人是偶尔介入该环节时受到感染，这种情况称为自然疫源性，这些疾病称为自然疫源性疾病，如鼠疫、钩体病（A对）、流行性出血热（B对）、森林脑炎（C对）、狂犬病（E对）等。地方性甲状腺肿（D错，为本题正确答案）属于疾病的自然地方性，又称为地方病。